以下描述与盐酸异丙肾上腺素不符合的是
A. 制备过程中要避免使用金属器具
B. 为β-肾上腺素受体激动剂
C. 性质不稳定，光、热可促进氧化
D. 水溶液加FeCl₃试液呈紫色
E. 本品遇甲醛硫酸试液先呈棕色，转变为暗紫色

正确答案：D。水溶液加FeCl₃试液呈紫色